H₂受体阻滞药物的应用是
A. 晕动症呕吐
B. 胃十二指肠溃疡
C. 皮肤瘙痒和水肿
D. 支气管哮喘
E. 过敏性鼻炎

正确答案：B。胃十二指肠溃疡

解析：H₂受体阻断药能选择性阻断壁细胞H₂受体，拮抗组胺引起的胃酸分泌。不仅能抑制基础胃酸分泌，对促胃液素、咖啡因、进食和刺激迷走神经等引起的胃酸分泌均有抑制作用，主要用于消化性溃疡、胃肠道出血、胃酸分泌过多症和食管炎等（B对）。